容易引起子宫内膜增生的卵巢肿瘤
A. 纤维瘤
B. 无性细胞瘤
C. 颗粒细胞瘤
D. 卵巢转移肿瘤
E. 畸胎瘤

正确答案：C。颗粒细胞瘤

解析：容易引起子宫内膜增生的卵巢肿瘤是颗粒细胞瘤（C对），在病理上颗粒细胞瘤分为成人型颗粒细胞瘤和幼年型颗粒细胞瘤，其中成人型颗粒细胞瘤能分泌雌激素，容易引起子宫内膜增生，甚至发生癌变常。纤维瘤（P330）（A错）的特点是可伴有腹腔积液或胸腔积液，手术切除肿瘤后，胸腔积液、腹腔积液自行消失，称之为梅格斯综合征；无性细胞瘤（P329）（B错）为卵巢恶性肿瘤，对放疗敏感；卵巢转移肿瘤（P331）（D错）是指体内任何部位如乳腺、肠、胃、生殖道、泌尿道等的原发癌，转移到卵巢形成的肿瘤，如库肯勃瘤，是一种特殊的卵巢转移性腺癌，原发部位在胃肠道，镜下见典型印戒细胞，能产生黏液；畸胎瘤（P329）（E错）分为成熟畸胎瘤和未成熟畸胎瘤，其中成熟畸胎瘤又称皮样囊肿，若肿瘤向单一胚层分化，可形成高度特异性畸胎瘤，如卵巢甲状腺肿，分泌甲状腺激素。以上四种卵巢肿瘤均无分泌雌激素功能，不能引起子宫内膜增生。